女，45岁。前额部疖肿10天。多次挤压排脓。今突发寒战、高热，伴头晕，无抽搐。查体：T40℃，P90次/分，R26次/分，BP100/70mmHg，神志清楚，前额红肿，伴脓头，胸壁及肢体皮下可见瘀斑。血WBC20.2×10⁹/L，核左移。血培养（-）。该患者目前的主要诊断是
A. 脓毒症
B. 额部蜂窝织炎
C. 菌血症
D. 颅内感染
E. 感染性休克

正确答案：A。脓毒症

解析：患者对面部疖多次挤压排脓后，出现高热、寒战、皮下瘀斑等全身症状，实验室检查WBC明显升高（正常值为4～10×10⁹/L）提示细菌严重感染。病菌可能经内眦静脉、眼静脉进入海绵窦，引起化脓性海绵状静脉窦炎，继而引发全身性感染（包括菌血症、脓毒症等）。脓毒症（七版黄家驷外科学P117）的确诊必须具备两个条件：①有活跃的细菌感染的确实证据，但血培养不一定为阳性；②有SIRS，即全身性炎症反应综合征。SIRS的四项标准符合两项即可诊断：体温＞38℃或＜36℃；心率＞90次/分；呼吸＞20次/分或有过度通气致PaCO₂＜4.3（32mmHg）；白细胞计数＞12×10⁹/L或＜4×10⁹/L，或幼稚细胞＞0.10。该患者有活跃的细菌感染的确实证据（突发寒战、高热，前额红肿，伴脓头），有SIRS（T40℃，R26次／分，血WBC20.2×10⁹/L）。综上，该患者目前的主要诊断是脓毒症（A对）。额部蜂窝织炎（B错）为局部感染性炎症。菌血症（P114）（C错）的诊断依据是血培养阳性。颅内感染（D错）常表现为头痛、呕吐、昏迷等症状，一般不出现瘀斑。该患者血压100/70mmHg，休克指数（脉率/收缩压）为0.9，暂未达到休克标准（休克指数＞1.0），故不能诊断为感染性休克（E错）。